有27个碳原子的胆烷酸是
A. 胆酸
B. 别胆酸
C. 牛磺酸
D. 粪甾烷酸
E. 绿原酸

正确答案：A。胆酸